患者，男，54岁。高血压病史多年，眩晕头痛，耳鸣，多梦，心烦易怒，口苦咽干，腰膝腿软，手足心热，舌红苔薄白，脉弦细数。其证型是
A. 肝风上扰
B. 痰浊中阻
C. 肝火亢盛
D. 阴虚阳亢
E. 肝肾阴虚

正确答案：D。阴虚阳亢

解析：患者高血压病史多年，肝阳上亢，上冒清空，故眩晕头痛，肝旺则易怒，肝火扰动心神，故心烦少寐，口苦咽干，腰膝腿软，手足心热，舌红苔薄白，脉弦细数，均为肝肾阴虚内热之侯，故可判断其证型为阴虚阳亢证（D对），治法为滋阴平肝潜阳，方药选用天麻钩藤饮加减。肝风上扰（A错）表现为半身不遂，口舌歪斜，语言謇涩或不语，眩晕耳鸣。痰浊中阻（B错）表现为头晕头痛，头重如裹，困倦乏力，胸闷，腹胀痞满，呕吐痰涎。肝火亢盛（C错）表现为头痛而眩，心烦易怒，睡眠不宁，胁痛，面红目赤，口苦。肝肾阴虚（E错）的特点为头晕耳鸣、目涩咽干、五心烦热、不寐、盗汗、腰膝酸软。